骨关节炎镇痛治疗首选
A. 口服阿司匹林
B. 口服氨基葡萄糖
C. 关节内注射透明质酸钠
D. 关节内注射激素
E. 口服对乙酰氨基酚

正确答案：A。口服阿司匹林

解析：根据八版教材对乙酰氨基酚（E对）为原正确答案，根据九版教材应首选的药物是非甾体类抗炎药，对乙酰氨基酚已不作为首选，应首选选阿司匹林（A对）。氨基葡萄糖（九版内科学P859）（B错）、关节内注射透明质酸钠（C错）均属于改善病情药物及软骨保护剂，可改善关节软骨的代谢，缓解骨关节炎疼痛症状，改善关节功能，但不作为首选。应避免关节内注射激素（D错），但对于急性发作的剧烈疼痛、夜间痛、关节积液的严重病例，可酌情应用。